每日饮纯酒精量超过多少持续10年以上应考虑酒精性心肌病
A. 90ml
B. 100ml
C. 110ml
D. 115ml
E. 125ml

正确答案：B。100ml

解析：九版内科学教材数据与本题选项不符。一般认为每日饮纯酒精量超过125ml（B对ACDE错），持续10年以上，如能排除其他心脏病，应考虑酒精性心肌病。强制性戒酒4～8周，积极治疗后病情迅速改善，亦支持酒精性心肌病的诊断。WHO标准为女性>40g/d，男性>80g/d，饮酒5年以上。纯乙醇密度为0.8g/ml，故酒精性量为100ml